关于主动脉，描述正确的是
A. 起自右心室
B. 是肺循环的动脉主干
C. 沿脊柱右侧下行
D. 起自左心房
E. 分为升主动脉、主动脉弓和降主动脉

正确答案：E。分为升主动脉、主动脉弓和降主动脉

解析：主动脉起自左心室（AD错）。是体循环（B错）的动脉主干。分为升主动脉、主动脉弓和降主动脉（E对）。